痰中检出石棉小体，说明
A. 患有石棉肺
B. 患肺癌
C. 患胸膜间皮瘤
D. 石棉作业工人
E. 接触过石棉

正确答案：E。接触过石棉

解析：本题考查石棉小体的概念。石棉小体是石棉纤维被巨噬细胞吞噬后，由一层含铁蛋白颗粒和酸性黏多糖包裹沉积于石棉纤维之上所形成的。痰中发现石棉小体，是石棉接触史（E对ABCD错）的金标准。但没有足够的证据证明痰中有石棉小体的患者一定患有尘肺或肺部疾病的证明，也不能完全确定其工作种类。